男性患者，军人，一次在野外扫雷任务当中被炸伤，其实施清创术的时间应为
A. 伤后24小时内
B. 伤后48小时内
C. 伤后12小时内
D. 伤后10小时内
E. 伤后6～8小时内

正确答案：E。伤后6～8小时内

解析：火器伤的初期外科早期清创应争取在伤后6～8小时内实施清创术。掌握“火器伤、热烧伤”知识点。